食品
A. 应当无毒、无害，符合应当有的营养要求
B. 应当有与产品品种，数量相适应的食品原料处理、加工、包装、贮存等厂房或者场所
C. 直接入口的食品应当有小包装或者使用无毒清洁的包装材料
D. 超过保质期限的食品
E. 必须进行健康检查

正确答案：A。应当无毒、无害，符合应当有的营养要求